塑料中可以与DNA结合，引起肝血管瘤的单体物质是
A. 苯乙烯
B. 聚乙烯
C. 氯乙烯
D. 三聚氰胺
E. 丙乙酰胺

正确答案：C。氯乙烯

解析：本题考查塑料中可以与DNA结合，引起肝血管瘤的单体物质。氯乙烯（C对ABDE错）可与DNA结合，引起肝血管肉瘤，并可产生毒性作用，主要表现在神经系统、骨骼和肝脏。